患者，男，因哮喘就诊。医生开具丙酸氟替卡松吸入气雾剂控制哮喘症状，建议使用2周，换用激素药物会产生全身性糖皮质激素副作用，就此咨询药师。下列关于丙酸氟替卡松吸入气雾剂的使用方法和注意事项的说法，错误的是
A. 使用前需摇匀储药罐，使药物充分混合
B. 使用时间嘴唇包绕住吸入器口，缓慢吸气并同时按动气阀给药
C. 丙酸氟替卡松吸入结束后不能漱口和刷牙
D. 吸入气雾剂中常用特殊的耐压给药装置，需避光、避热，防止爆炸
E. 吸入气雾剂中常使用抛射剂，在常压下沸点低于室温，需安全保管

正确答案：C。丙酸氟替卡松吸入结束后不能漱口和刷牙

解析：本题考查气雾剂。丙酸氟替卡松吸入结束后口腔会有残留的药物，需用清水漱口（C错，为本题正确答案）；使用前需摇匀储药罐，使药物与抛射剂充分混合（A对）；使用时嘴唇包绕住吸入器口，缓慢吸气并同时按动气阀给药（B对）；吸入气雾剂中常用特殊的耐压给药装置，需避光、避热，防止爆炸（D对）；吸入气雾剂中常使用抛射剂，在常压下沸点低于室温，需安全保管（E对）。